硬脑膜形成物不包括
A. 大脑镰
B. 脚间池
C. 小脑幕
D. 小脑镰
E. 海绵窦

正确答案：B。脚间池

解析：脚间池（B对）为两侧大脑脚之间扩大的蛛网膜下隙称蛛网膜下池。大脑镰（A错）、小脑幕（C错）、小脑镰（D错）、海绵窦（E错）均为硬脑膜形成物，其中海绵窦为硬脑膜两层分开形成的，内面衬以内皮细胞，此结构称为硬脑膜窦。